药品管理法规定实行品种保护的是
A. 新药
B. 处方药
C. 非处方药
D. 医疗机构配制的制剂
E. 中药

正确答案：E。中药

解析：本题考查中药。药品管理法规定实行品种保护的是中药（E对）。根据《中华人民共和国药品管理法》第三十六条规定，国家实行中药品种保护制度，具体办法由国务院制定。新药（A错）是指未曾在中国境内上市销售的药品。处方药（B错）是指凭执业医师和执业助理医师处方方可购买、调配和使用的药品。非处方药（C错）是指由国务院药品监督管理部门公布的，不需要凭执业医师和执业助理医师处方，消费者可以自行判断、购买和使用的药品。医疗机构制剂（D错）是指医疗机构根据本单位临床需要经批准而配制、自用的固定处方制剂。